治疗其他降压效果不佳的严重高血压可选用的药是
A. 普罗帕酮
B. 噻氯匹定
C. 洛伐他汀
D. 多巴酚丁胺
E. 米诺地尔

正确答案：E。米诺地尔

解析：本题考查高血压用药。米诺地尔（E对）口服可用于治疗其他降压药无效的重症高血压。